根据《处方管理办法》，不符合处方规则的是
A. 西药和中成药可在同一张处方上开具
B. 字迹清楚，不得涂改
C. 新生儿、婴幼儿年龄应写日、月龄
D. 中成药和中药饮片可在同一张处方上开具
E. 对饮片产地有特殊要求的，应在药品名称之前写明

正确答案：D。中成药和中药饮片可在同一张处方上开具

解析：本题考查处方管理的一般规定。根据《处方管理办法》，不符合处方规则的是中成药和中药饮片可在同一张处方上开具（D错，为本题正确答案）。西药和中成药可以分别开具处方，也可以开具一张处方（A对），中药饮片应当单独开具处方。字迹清楚，不得涂改（B对）；如需修改，应当在修改处签名并注明修改日期。患者年龄应当填写实足年龄，新生儿、婴幼儿写日、月龄（C对），必要时要注明体重。对饮片的产地、炮制有特殊要求的，应在药品名称之前写明（E对）。